颅内压增高的典型临床表现是
A. 偏瘫，偏盲，偏身感觉障碍
B. 头痛，恶心，偏瘫
C. 头痛，抽搐，意识障碍
D. 头痛，呕吐，视乳头水肿
E. 头痛，呕吐，血压升高

正确答案：D。头痛，呕吐，视乳头水肿

解析：颅内压增高的典型临床表现是头痛、呕吐、视乳头水肿（D对）。偏瘫、偏盲、偏身感觉障碍（A错）称为“三偏征”，是内囊部位病变的主要体征，常见于内囊出血。部分严重颅内压升高的患者可出现抽搐，伴有阵发性意识丧失（C错），并非颅内压增高的典型表现。急性颅内压升高可引起血压升高（E错），但并非颅内压增高的典型表现。颅内压增高时一般不会出现偏瘫（B错）。